服药期间进食高脂肪可促进吸收的药品是
A. 格列本脲
B. 硫酸亚铁
C. 维生素D
D. 西咪替丁
E. 左旋多巴

正确答案：C。维生素D

解析：本题考查饮食对药物疗效的影响。维生素D（C对）属于脂溶性维生素，服药期间进食高脂肪食物可促进药物吸收。格列本脲（A错）为磺酰脲类促胰岛素分泌药物，服药期间进食高脂肪不会促进吸收。高脂肪食物可抑制胃酸分泌，与铁剂（B错）结合生成难溶的物质，影响铁剂的吸收。西咪替丁（D错）为抑酸剂，服用西咪替丁期间进食高脂肪食物不会促进吸收。左旋多巴（E错）通过血脑屏障进入脑组织发挥作用，服用左旋多巴期间进食高脂肪食物不会促进吸收。